呼出大蒜味气体可能是（）中毒
A. 酒精
B. 氰化物
C. 有机磷
D. 甲醇
E. 吗啡

正确答案：C。有机磷